麻疹合并肺炎患儿需隔离至出疹后
A. 3天
B. 5天
C. 7天
D. 10天
E. 14天

正确答案：D。10天

解析：麻疹属于传染性呼吸道疾病，控制传染源是预防麻疹的重要步骤，对麻疹患者要做到早发现、早报告、早隔离、早治疗。麻疹患者出疹前后5天均有传染性，一般隔离至出疹后5天，合并肺炎或其他并发症的患者应延长至出疹后10天（D对）。